多唾或久唾，则易耗伤
A. 肺中津气
B. 肾中精气
C. 肝的阴血
D. 脾的阴液
E. 心的气血

正确答案：B。肾中精气

解析：唾为口津，即唾液中较粘稠的部分，多出于舌下，具有润泽口腔，滋润食物及滋养肾精的作用，唾由肾精化生，肾精在肾气的作用下，沿足少阴肾经到达舌下或齿缘，分泌而出则为唾。多唾久唾，则能耗伤肾精（B对）。